直肠齿状线以下的淋巴管注入
A. 腹股沟浅淋巴结
B. 腹股沟深淋巴结
C. 直肠上淋巴结
D. 肠系膜下淋巴结
E. 腰淋巴结

正确答案：A。腹股沟浅淋巴结

解析：直肠齿状线以上的淋巴管注入直肠上淋巴结（C错），直肠齿状线以下的淋巴管注入腹股沟浅淋巴结（A对）。